患者，女，58岁。脑动脉硬化6年。突然发生口眼㖞斜，半身不遂。半小时后，自行恢复。平日头晕头痛，耳鸣，腰膝酸软，舌红，苔薄黄，脉弦细。应首先考虑的方剂是
A. 镇肝熄风汤
B. 参附汤合生脉散
C. 涤痰汤
D. 补阳还五汤
E. 血府逐瘀汤

正确答案：A。镇肝熄风汤

解析：患者有脑动脉硬化病史，风阳内动，挟痰走窜经络，经络不畅，故见突然发生口眼㖞斜，半身不遂；肾阴素亏，肝阳上亢故见头晕头痛，耳鸣，腰膝酸软；舌红，苔薄黄，脉弦细，属于肝肾亏虚，肝阳化风所致；治疗应选择镇肝息风，滋阴潜阳的镇肝熄风汤治疗（A对）。参附汤合生脉散（B错）可以益气回阳，救阴固脱，用于元气败脱，心神涣散证的治疗。涤痰汤（C错）可以辛温开窍，豁痰息风，用于中风痰迷心窍证的治疗。补阳还五汤（D错）可以益气养血，化瘀通络，用于气虚血瘀证的治疗。血府逐瘀汤（E错）可以理气活血，化瘀止痛，用于治疗胸中血瘀之证。